Q波型急性心肌梗死心电图特征为
A. 宽而深的Q波，ST段呈弓背向上抬高，T波倒置
B. 宽而深的Q波，ST段降低，T波抬高
C. 宽而深的Q波，ST段降低，T波倒置
D. 浅而宽的Q波，ST段降低，T波抬高
E. 浅而宽的Q波，ST段抬高，T波倒置

正确答案：A。宽而深的Q波，ST段呈弓背向上抬高，T波倒置

解析：正常人的Q波时限一般不超过0.03s，深度不超过同导联R波振幅的1/4（九版诊断学P490）。病理性Q波是指①Q波宽度≥0.04s；②Q波振幅大于同导联R波的1/4；③不该出现Q波的导联上出现了Q波。根据定义可知病理性Q波宽度更大，振幅更高。因此Q波型急性心肌梗死心电图特征为宽而深的Q波（病理性Q波）（P237）（E错），ST段呈弓背向上抬高（BCD错），T波倒置（A对）。